预防破伤风
A. 丙种球蛋白
B. 类毒素或抗病毒
C. 活疫苗
D. 化学药品
E. 灭活菌苗

正确答案：B。类毒素或抗病毒

解析：本题考查破伤风的预防。预防破伤风可接种类毒素或抗病毒（B对ACDE错）。